发生应激性溃疡最常见的部位是
A. 十二指肠
B. 空肠
C. 口腔
D. 胰腺
E. 胃

正确答案：E。胃

解析：应激性溃疡是指在严重创伤、手术、多器官功能衰竭、败血症、精神紧张等应激状态下消化道出现急性糜烂和溃疡。这些应激状态可致胃黏膜微循环障碍、缺氧、黏液分泌减少，局部前列腺素合成不足，屏障功能损害；也可增加胃酸分泌，大量氢离子反渗，损伤血管和黏膜，引起糜烂和出血，多发生于胃（E对），也可累及食管或十二指肠（A错）。一般不会发生于空肠（B错）、口腔（C错）、胰腺（D错）。